行于颈动脉鞘内的是
A. 迷走神经
B. 喉上神经
C. 喉返神经
D. 颈交感干
E. 舌下神经

正确答案：A。迷走神经

解析：在颈部迷走神经（A对）行于颈内静脉与颈内动脉或颈总动脉之间的后方，下行经胸廓上口进入胸腔。喉上神经（B错）于颈内动脉内侧下行，在舌骨大角处分为内、外两支。左、右喉返神经（C错）分别行于两侧气管与食管之间的沟内或附近，有甲状腺下动脉与其伴行。颈交感干（D错）位于颈血管鞘后方，颈椎横突的前方。舌下神经（E错）出颅后向下行于颈内动、静脉之间至舌骨上方，呈弓形行向前内，沿舌骨舌肌浅面分支进入舌内。